不属于牛膝功效的是
A. 活血祛瘀
B. 强健筋骨
C. 引火归元
D. 利尿通淋
E. 补益肝肾

正确答案：C。引火归元

解析：牛膝具有活血通经，本品活血祛瘀力较强（A错）。补肝肾（E错），强筋骨（B错）利水通淋治疗淋证，水肿，小便不利（D错），引火（血）下行的功效（C对）。